某妇女，患病后开始积极锻炼身体，注意日常饮食。她的儿子虽然没病，在她的影响下也开始进行规律的体育锻炼，多吃蔬菜、水果了。她儿子的行为属于
A. 预防性行为
B. 患者角色行为
C. A型行为
D. C型行为
E. 自我保护行为

正确答案：A。预防性行为